根据《麻醉药品、第一类精神药品购用印鉴卡管理规定》，医疗机构申请《印签卡》应当符合的条件是
A. 具有公安报警系统联网的报警装置
B. 有与使用麻醉药品和第一类精神药品相关诊疗科目
C. 具有使用麻醉药品、精神药品能力的主治医师以上的医师
D. 具有兼职从事麻醉药品和第一类精神药品管理的药学专业技术人员
E. 有专用的麻醉药品、精神药品计算机管理系统

正确答案：B。有与使用麻醉药品和第一类精神药品相关诊疗科目

解析：本题考查取得《印鉴卡》的必备条件。根据《麻醉药品、第一类精神药品购用印鉴卡管理规定》，医疗机构申请《印签卡》应当符合的条件是有与使用麻醉药品和第一类精神药品相关诊疗科目（B对）。取得《印鉴卡》的必备条件：医疗机构向设区的市级卫生行政部门提出办理《印鉴卡》，应当具备下列条件。（1）有与使用麻醉药品和第一类精神药品相关的诊疗科目。（2）具有经过麻醉药品和第一类精神药品培训的、专职从事麻醉药品和第一类精神药品管理的药学专业技术人员（D错）。（3）有获得麻醉药品和第一类精神药品处方资格的执业医师（C错）。（4）有保证麻醉药品和第一类精神药品安全储存的设施和管理制度。